关于戊型肝炎病毒（HEV）的致病特性，下列描述中错误的是
A. 经消化道途径传播
B. 15～35岁青壮年感染后发病者居多
C. 多于发病后6周康复，不引起慢性肝炎
D. 孕妇患者的病死率不高
E. 患者血清抗-HEV阳性，有助于急性戊型肝炎诊断

正确答案：D。孕妇患者的病死率不高